维生素D缺乏性佝偻病不正确的预防措施是
A. 适当多晒太阳
B. 提倡母乳喂养
C. 孕母补充维生素D及钙剂
D. 及时添加辅食
E. 早产儿2个月开始补充维生素D

正确答案：E。早产儿2个月开始补充维生素D

解析：为预防维生素D缺乏性佝偻病，早产儿应从出生后1周（E错，为本题正确答案）开始补充维生素D。紫外线的照射有利于维生素D的合成，因此孕妇和婴儿适当多晒太阳（A对），可以预防维生素D缺乏性佝偻病。另外母乳中所含钙磷的比例，最适于吸收，所以母乳喂养可以预防维生素D缺乏性佝偻病（B对）。孕母补充维生素D及钙剂，可预防围生期宫内的胎儿维生素D缺乏（C对）。处于生长高峰期的胎儿，及时的添加辅食可以预防维生素D缺乏性佝偻病（D对）。